糖衣片的崩解时限是
A. 10分钟
B. 20分钟
C. 30分钟
D. 40分钟
E. 60分钟

正确答案：E。60分钟

解析：本题考查片剂的崩解时限。普通片剂的崩解时限为15min、薄膜衣片崩解时限30min、糖衣片崩解时限为1h（E对）、肠溶衣崩解时限为1h。